肯定有神经分布的牙本质是
A. 小管周牙本质
B. 小管间牙本质
C. 前期牙本质
D. 罩牙本质
E. 透明牙本质

正确答案：C。前期牙本质

解析：本题考查牙本质敏感症的发生机制-神经终末传导学说。肯定有神经分布的牙本质是前期牙本质（C对）。前期牙本质是一层未矿化的牙本质，位于牙髓的成牙本质细胞层与矿化的牙本质之间。牙髓中的无髓鞘神经仅有一部分进入前期牙本质和牙本质层，且限于内1/3；外围牙本质没有神经结构。小管周牙本质（A错）、小管间牙本质（B错）、罩牙本质（D错）与透明牙本质（E错）均为外围牙本质，无神经分布。